下列有关单克隆抗体说法正确的是
A. 由单一杂交瘤细胞产生，针对单一抗体表位的特异性抗体
B. 由多种杂交瘤细胞产生，针对单一抗体表位的特异性抗体
C. 由多种杂交瘤细胞产生，针对单一抗原表位的特异性抗体
D. 由单一杂交瘤细胞产生，针对单一抗原表位的特异性抗体
E. 由单一杂交瘤细胞产生，针对复杂抗原表位的特异性抗体

正确答案：D。由单一杂交瘤细胞产生，针对单一抗原表位的特异性抗体

解析：由单一杂交瘤细胞产生，针对单一抗原表位的特异性抗体，称为单克隆抗体。掌握“各类球蛋白的特性和功能”知识点。